患者，男，62岁。高血压病史10年，既往有骨关节炎和血脂异常，轻度心功能不全。近期体检发现血压162/80mmHg，心率72次/分。该患者目前服用的药物除抗高血压药外有辛伐他汀、双氯芬酸、氨基葡萄糖、甲钴胺及碳酸钙D。服药4周后患者复查血压145/78mmHg，血尿酸512㎛ol/L，引起血尿酸升高的药物可能是
A. 特拉唑嗪
B. 美托洛尔
C. 氢氯噻嗪
D. 双氯芬酸
E. 氨氯地平

正确答案：C。氢氯噻嗪

解析：本题考查氢氯噻嗪的不良反应。引起血尿酸升高的药物可能是氢氯噻嗪（C对）。氢氯噻嗪的不良反应：1.电解质紊乱，表现为：①低钾血症；②低氯性碱中毒或低氯、低钾性碱中毒；③低钠血症；④脱水造成血容量和肾血流量减少亦可引起肾小球滤过率降低；⑤升高血氨；⑥高钙血症；⑦高尿酸血症；⑧血磷、镁及尿钙降低。2.升高血糖。3.升高血脂。4.性功能减退。5.噻嗪类利尿药可引起中枢神经系统（如眩晕、头痛）、胃肠道、血液系统（白细胞减少、血小板减少等）和皮肤反应（如光敏反应和皮疹）等不良反应。特拉唑嗪（A错）属于α受体阻断剂，常见不良反应为体位性低血压。美托洛尔（B错）为选择性β₁受体阻断剂，常见不良反应有疲乏、肢体冷感、激动不安、胃肠不适等。长期应用者突然停药后可发生反跳现象。双氯芬酸（D错）为解热镇痛抗炎药，常见不良反应为胃肠道反应。氨氯地平（E错）属于钙通道阻滞剂，常见反射性交感神经激活导致心跳加快、面部潮红、脚踝部水肿、牙龈增生等。